气分热盛的脉象为
A. 虚数脉
B. 洪数脉
C. 濡数脉
D. 细数脉
E. 浮数脉

正确答案：B。洪数脉

解析：洪数脉主气分热盛（B对），多见于阳明经证、外感热病。由于机体内阳气有余、内热充斥，而致使脉道扩张，气盛血涌，故出现洪脉。机体邪热内盛，正气不衰，邪正相争，故气血运行加速，出现数脉。虚脉见于虚证，多为气血两虚（A错）。濡脉多见于虚证或湿证（C错）。细脉多见于虚证或湿证（D错）。浮数脉多见于风热袭表的表热证（E错）。